赵献可认为
A. 右肾为命门
B. 命门为两肾的总称
C. 两肾之间为命门
D. 命门为肾间动气
E. 命门为精室

正确答案：C。两肾之间为命门

解析：赵献可首推命门在两肾之间（C对）。《难经》首先提出右肾为命门说（A错）。虞抟《医学正传·医学或问》提出两肾总号为命门。（B错）。孙一奎《医旨绪余》提出命门乃两肾之间动气（D错）。张介宾认为命门为子宫，精室，亦属有形（E错）。